女，58岁。双下肢及颜面水肿2个月。尿蛋白5.2g/24h，血白蛋白19g/L。1天来出现肉眼血尿。首选应考虑的诊断是
A. 肾小球病进展
B. 尿路感染
C. 尿路结石
D. 急性肾炎
E. 肾静脉血栓

正确答案：E。肾静脉血栓

解析：患者出现水肿两个月，尿蛋白5.2g/24h（大于3.5g/d），血浆白蛋白19g/L（低于30g/L），符合肾病综合征的诊断标准，可诊断为肾病综合征。肾病综合征容易发生血栓形成，患者一天来突发血尿，符合肾静脉血栓形成症状（E对）。肾小球病进展有可能导致患者血尿出现，但是一般发生于病变未控制时，肾功能不全症状加重，患者未明确表现肾病综合征及肾功能不全症状加重，因此不作为首选诊断（A错）。尿路感染（B错）常出现尿频、尿急、尿痛等泌尿系统症状（P483），本题未明确表明患者有这些症状，故不作为首选。尿路结石（C错）一般会出现疼痛，血尿及尿路刺激症状（九版外科学P558），患者未出现这些典型症状，所以不作为首选诊断。急性肾炎（D错）一般起病时即有血尿，但本患者开始起病时无血尿症状，因此不作为首选诊断（P466）。